缺铁性贫血神经系统表现
A. 智力及动作发育落后有倒退现象
B. 兴奋多动
C. 注意力不集中，记忆力减退
D. 腱反射减弱
E. 感觉异常

正确答案：C。注意力不集中，记忆力减退

解析：缺铁性贫血患者常常有可能会出现注意力不集中，失眠多梦，然后入睡困难以及记忆力减退等神经系统的症状（E错C对）；营养性巨幼红细胞性贫血神经系统症状表现为表情呆滞、嗜睡、对外界反应迟钝、少哭或不哭、智力发育和动作发育落后（A错）；铁元素缺乏，出现缺铁性贫血，造成身体供血不足，影响大脑发育，引发多动症（B错）；巨幼红细胞贫血者神经系统病变可能致肌张力减退和腱反射减弱（D错）。